长期用药可发生耐受性和依赖性的药物是
A. 阿司匹林
B. 苯妥英钠
C. 地西泮
D. 氯丙嗪
E. 卡马西平

正确答案：C。地西泮